提高药物制剂稳定性的方法有
A. 制备稳定衍生物
B. 制备难溶性盐类
C. 制备固体制剂
D. 制备微囊
E. 制备包合物

正确答案：A、B、C、D、E。制备稳定衍生物；制备难溶性盐类；制备固体制剂；制备微囊；制备包合物

解析：本题考查药物制剂稳定化方法。提高药物制剂稳定化方法有：1.改进剂型或生产工艺：（1）制成固体制剂（C对）：凡在水溶液中不稳定的药物，制成固体制剂可显著改善其稳定性。（2）制成微囊（D对）或包合物（E对）：采用微囊化和包合技术，可防止药物因受环境中的氧气、度、水分、光线的影响而降解，或因挥发性药物挥发而造成损失，从而增加药物的稳定性。2.制备稳定的衍生物（A对）：对不稳定的成分进行结构改造，如制成盐类（B对）、酯类、酰胺类或高熔点衍生物，可以提高制剂的稳定性。3.加入干燥剂或改善包装。